中等卫校毕业生林某，在乡卫生院工作，2000年取得执业助理医师执业证书。他要参加执业医师资格考试，根据《执业医师法》规定，应取得执业助理医师执业证书后，在医疗机构中工作满
A. 6年
B. 5年
C. 4年
D. 3年
E. 2年

正确答案：B。5年

解析：根据《执业医师法》和相关规定，具有下列条件之一的，可以参加执业医师资格考试：①具有高等学校医学专业本科以上学历（是指国务院教育行政部门认可的各类高等学校医学专业本科以上学历），在执业医师指导下，在医疗、预防、保健机构中试用期满1年；②取得执业助理医师执业证书后，具有高等学校医学专科学历（是指省级以上教育行政部门认可的各类高等学校医学专业专科学历），在医疗、预防、保健机构中工作满2年；③具有中等专业学校医学专业学历（是指经省级以上教育行政部门认可的各类中等专业学校医学专业中专学历），在医疗、预防、保健机构中工作满5年（B对）；④以师承方式学习传统医学满3年或者经多年实践医术确有专长的，经县级以上人民政府卫生行政部门确定的传统医学专业组织或者医疗、预防、保健机构考核合格并推荐；⑤在1998年6月26日前获得医士专业技术职务资格，后又取得执业助理医师资格，医士从业时间和取得执业助理医师执业证书后执业时间累计满5年；⑥7年制临床医学、口腔医学、中医学的临床硕士生和8年制毕业生在学习期间有相当于大学本科的1年生产实习和1年以上严格的临床实践训练，可在毕业当年参加医师资格考试（B对）。林某为中等卫校毕业，符合第三条规定。